腹膜外位器官，不包括
A. 肾上腺
B. 肾
C. 胰
D. 输尿管
E. 胆囊

正确答案：E。胆囊

解析：肾（B对）、肾上腺（A对）、输尿管（D对）,十二指肠降部和水平部,直肠中、下段及胰（C对）等为腹膜外位器官。胆囊（E错，为本题正确答案）为腹膜间位器官。